特殊医学用途配方食品的广告应标注
A. “请按药品说明书或者在药师指导下购买和使用”
B. “请按药品说明书或者在医务人员指导下购买和使用”
C. “请在医师或者临床营养师指导下使用”
D. “本广告仅供医学药学专业人士阅读”

正确答案：C。“请在医师或者临床营养师指导下使用”

解析：本题考查广告发布的内容准则。特殊医学用途配方食品广告应当显著标明适用人群、“不适用于非目标人群使用”“请在医师或者临床营养师指导下使用”（C对）。药品广告应当显著标明禁忌、不良反应，处方药广告还应当显著标明“本广告仅供医学药学专业人士阅读”（D错），非处方药广告还应当显著标明非处方药标识（OTC）和“请按药品说明书或者在药师指导下购买和使用”（A错）。